首先考虑胃癌的临床表现是
A. 吞咽困难
B. 上腹痛伴贫血
C. 反复反酸、烧心伴胸痛
D. 突发上腹刀割样疼痛向腰背部放射
E. 间断餐后上腹部胀痛伴嗳气，不影响睡眠

正确答案：B。上腹痛伴贫血

解析：胃癌的主要表现为：腹痛、消化道出血、消瘦、恶病质（B对）；吞咽困难，尤以进行性加重者严重怀疑食管癌（A错）；反复反酸、烧心伴胸痛多见于胃食管反流病（C错）；突发上腹刀割样疼痛向腰背部放射，高度怀疑胰腺病变，因胰腺为腹膜后器官故疼痛常放射至腰背部（D错）；间断餐后上腹部胀痛伴嗳气，不影响睡眠，多见于功能性消化不良（E错）。